正确描述正中神经的是
A. 发自颈丛
B. 在上臂发支支配上臂伸肌
C. 分布到小鱼际肌及尺侧三个半手指掌面皮肤
D. 伴随肱动脉下行到肘窝
E. 在肘窝以上分支支配上臂屈肌

正确答案：D。伴随肱动脉下行到肘窝

解析：正中神经由臂丛发出（A错），，先行于动脉的外侧，继而在臂部沿肱二头肌内侧沟下行。下行途中，逐渐从外侧跨过肱动脉至其内侧，伴随同名血管一起降至肘窝（D对）。正中神经在前臂的分布范围较广，支配除肱桡肌、尺侧腕屈肌和指深屈肌尺侧半以外的所有前臂屈肌和旋前肌（E错）。正中神经在手部的分布可概括为：运动纤维支配第1、2蚓状肌和鱼际肌（拇收肌除外），感觉纤维则分布于桡侧半手掌、桡侧三个半手指掌面皮肤及其中节和远节指背皮肤（C错）。